《医疗机构制剂配制监督管理办法（试行）》规定，《医疗机构制剂许可证》项目中，由药品监督管理部门核准的许可事项为
A. 医疗机构名称，医疗机构类别，法定代表人，制剂室负责人
B. 制剂室负责人，配制地址，配制范围，有效期限
C. 医疗机构名称，配制地址，注册地址
D. 法定代表人，制剂室负责人，药检室负责人
E. 医疗机构类别，配制范围，有效期限

正确答案：B。制剂室负责人，配制地址，配制范围，有效期限

解析：本题考查的是《医疗机构制剂许可证》的管理。《医疗机构制剂配制监督管理办法（试行）》规定，《医疗机构制剂许可证》项目中，由药品监督管理部门核准的许可事项为制剂室负责人，配制地址，配制范围，有效期限（B对）。《医疗机构制剂许可证》是医疗机构配制制剂的法定凭证，应当载明证号、医疗机构名称、医疗机构类别、法定代表人、制剂室负责人、配制范围、注册地址、配制地址、发证机关、发证日期、有效期限等项目。其中由药品监督管理部门核准的许可事项为：制剂室负责人、配制地址、配制范围、有效期限。证号和配制范围按国家药品监督管理部门规定的编号方法和制剂类别填写。《医疗机构制剂许可证》分正本和副本，具有同等法律效力。